口腔白色角化病最有效的治疗是
A. 手术切除
B. 口服维生素A酸
C. 局部涂敷维生素A酸制剂
D. 去除局部刺激因素
E. 局部注射2．5％波尼松龙混悬液

正确答案：D。去除局部刺激因素

解析：本题考查口腔白色角化病的治疗。口腔白色角化病为长期的机械性或化学性刺激所造成的口腔黏膜局部白色角化斑块或斑片，故最有效的治疗是去除刺激因素（D对）。手术切除（A错）常是白斑、红斑的有效治疗方法。口腔白色角化病角化严重者局部使用维A酸制剂（C错）有一定效果，但不是最有效地治疗方法。局部涂敷维生素A酸制剂而不应口服维生素A酸（B错）。局部注射2．5％波尼松龙混悬液（E错）对治疗天疱疮有效。